社会因素作用与健康的调节器是
A. 感知觉系统
B. 神经
C. 神经-内分泌
D. 神经-内分泌-免疫系统
E. 大脑

正确答案：E。大脑